肿瘤分期是指
A. 肿瘤细胞的分化程度
B. 肿瘤细胞的恶性程度
C. 肿瘤细胞核分裂象的多少
D. 肿瘤的生长范围和扩散程度
E. 肿瘤细胞的浸润及转移能力

正确答案：D。肿瘤的生长范围和扩散程度

解析：肿瘤分期是指恶性肿瘤的生长范围和播散程度（D对），对肿瘤进行分期需要考虑浸润深度、范围、邻近器官受累情况，局部和远处淋巴结转移情况等，而不是肿瘤细胞的浸润及转移能力（E错）。肿瘤细胞的分化程度（A错）、核分裂象的多少（C错）是对恶性肿瘤进行分级的标准。肿瘤细胞的恶性程度（B错）是描述肿瘤良恶性的指标。